下列关于酒剂的特点叙述，正确的有
A. 酒辛甘大热，可促使药物吸收，提高药物疗效
B. 组方灵活，制备简便，不可加入矫味剂
C. 能活血通络，但不适宜于心脏病患者服用
D. 临床上以祛风活血、止痛散瘀效果尤佳
E. 含乙醇量高，久贮不易变质

正确答案：A、C、D、E。酒辛甘大热，可促使药物吸收，提高药物疗效；能活血通络，但不适宜于心脏病患者服用；临床上以祛风活血、止痛散瘀效果尤佳；含乙醇量高，久贮不易变质

解析：本题考查的是酒剂。下列关于酒剂的特点叙述，正确的有、酒辛甘大热，可促使药物吸收，提高药物疗效（A对）、能活血通络，但不适宜于心脏病患者服用（C对）、临床上以祛风活血、止痛散瘀效果尤佳（D对）与含乙醇量高，久贮不易变质（E对）。酒剂：（一）特点与分类：1.特点：酒剂系指中药饮片用蒸馏酒提取制成的澄清液体制剂。酒剂是我国应用最早的中药剂型之一。酒辛甘大热，能散寒、行血通络，作为提取溶剂有利于有效成分浸出，且具有易于分散、助长药效之特性。故祛风散寒、活血通络、散瘀止痛等方剂常制成酒剂。酒剂制备简便，剂量较小，服用方便，且不易霉变，易于保存。2.分类：按照给药途径，酒剂可分为内服酒剂与外用酒剂，其中酒剂多供内服。（二）质量要求：生产酒剂所用的饮片一般应适当粉碎。内服酒剂应以谷类酒为溶剂，可用浸渍法、渗漉法或其他适宜方法制备。酒剂中可加入适量的糖或蜂蜜调味（B错）。配制后的酒剂需静置澄清，滤过后分装于洁净的容器中，在贮存期间允许有少量摇之易散的沉淀。应检查乙醇含量和甲醇含量。除另有规定外，酒剂应密封，置阴凉处贮存。按照《中国药典》规定的方法检查，总固体、乙醇量、甲醇量、装量及微生物限度等均应符合有关规定。（三）临床应用注意事项：酒剂为澄清液体，允许有少量轻摇易散的沉淀，但沉淀较多者不宜使用。酒剂内服应注意用量，儿童、孕妇、心脏病及高血压患者不宜服用。